我国鉴定肉类食品鲜度最常用的化学指标为
A. TVBN
B. 三甲胺
C. K值
D. 过氧化物值
E. 碘价

正确答案：A。TVBN